不能使足跖屈的肌肉是
A. 小腿三头肌
B. 胫骨后肌
C. 胫骨前肌
D. 腓骨长肌
E. 腓骨短肌

正确答案：C。胫骨前肌

解析：胫骨前肌（C错，为本题正确答案）伸踝关节，使足内翻，而不能使足跖屈。